上颌骨骨化中心向哪个方向进行生长形成牙槽突
A. 向前
B. 向后
C. 向下
D. 向外
E. 向上

正确答案：C。向下

解析：本题考查颌骨的发育。上颌骨从骨化中心向下（C对）形成牙槽突。上颌骨从骨化中心向以下几个方向生长：①向上形成上颌骨额突并支持眶部；②向后形成颧突；③向内形成腭突；④向下形成牙槽突；⑤向前形成上颌的表面组织。